疾病三间分布包括
A. 时间分布、人群分布、地区分布
B. 空间分布、时间分布、人群分布
C. 人群分布、地区分布、种族分布
D. 地区分布、空间分布、人群分布
E. 人群分布、地区分布、期间分布

正确答案：A。时间分布、人群分布、地区分布

解析：疾病三间分布：①地区分布；②时间分布；③人群分布。掌握“流行病学资料与疾病分布”知识点。